仅浸润黏膜层及黏膜下层的胃肠癌称
A. 交界性肿瘤
B. 早期癌
C. 良性肿瘤
D. 恶性肿瘤
E. 癌前病史

正确答案：B。早期癌

解析：仅浸润黏膜层及黏膜下层的胃肠癌称为早期癌（B对）。交界性肿瘤（A错）是指组织形态和生物学行为介于良、恶性之间的肿瘤。良性肿瘤（C错）指异型性小，生长缓慢，对机体影响较小的肿瘤。恶性肿瘤（D错）指异型性大，生长较快，易发生转移，且对机体影响较大的肿瘤。癌前病变（E错）指某些疾病（或病变）虽然本身不是恶性肿瘤，但具有发展为恶性肿瘤的潜能。